测定粉体粒径的常用方法有
A. 电感应法
B. 沉降法
C. 筛分法
D. 显微镜法
E. 水飞法

正确答案：A、B、C、D。电感应法；沉降法；筛分法；显微镜法

解析：本题考查测定粉体粒径的常用方法。测定粉体粒径的常用方法有电感应法（A对）、沉降法（B对）、筛分法（C对）、显微镜法（D对）、库尔特记数法、激光衍射/散射法等。水飞法（E错）是药物粉碎方法。